女孩，4岁，发热、头痛3天，呕吐2次呈喷射状。入院当天晚上开始频繁抽搐，呈全身性。3~4分钟停止。抽搐后昏睡，体温39℃，面色灰白。血白细胞22×10⁹/L，中性粒细胞88%。若该患儿拟诊断为化脓性脑膜炎在查体时。最可能发现的是
A. 呼吸不规则，深昏迷
B. 瞳孔不等大，对光反射消失
C. 颈强存在，神经系统检查有异常
D. 四肢肌张力增强，腱反射亢进
E. 血压明显升高

正确答案：C。颈强存在，神经系统检查有异常

解析：学龄前儿童，发热、头痛3天，呕吐2次呈喷射状，入院当天晚上开始频繁抽搐，呈全身性，3～4分钟停止，抽搐后昏睡，体温39℃（正常值为正常值为36℃～37℃，发热，高热），面色灰白，血白细胞22×10⁹/L（正常值为4～10×10⁹/L，白细胞升高），中性粒细胞88%（正常值为50%～70%，中性粒细胞增高），若该患儿拟诊断为化脓性脑膜炎在查体时最可能发现的是颈强存在，神经系统检查有异常（C对），当患儿合并脑疝时才可能出现瞳孔不等大，对光反射消失（B错），呼吸不规则不易发现及确定，当患儿病情进展到一定程度才会出现深昏迷（A错），血压升高并不明显（E错）。